女性72岁。银行职员，高中文化，3年前开始记忆力下降，逐渐加重，刚吃完饭就忘记，说没吃饭，记不住孙子的名字，把子女错认为别人，远记忆力尚可，经常吵闹要回原来家，有时焦虑，简单计算均可，复杂计算力差，在家乱翻东西，自己存折忘记放在什么地方，找不到认为被女儿偷去了，躯体及神经系统检查无显著体征。最可能的诊断是
A. 老年性痴呆
B. 脑肿瘤
C. 脑血管疾病
D. 人格改变
E. 抑郁症

正确答案：A。老年性痴呆

解析：该患者老年女性，3年前开始记忆力下降，逐渐加重（日益严重的记忆障碍），认不出子女（失认），远记忆力尚可，简单计算均可，复杂计算力差（计算力障碍），忘记存折放置的地方，没找到便怀疑被女儿偷了（被窃妄想），躯体及神经系统检查无著征（排除其他原因引起的痴呆），故最可能的诊断是老年痴呆（阿尔茨海默病）（A对）。抑郁发作以显著而持久的情感低落（忧愁、苦闷、唉声叹气、暗自落泪等）为主要表现，伴有兴趣缺乏、快感缺失等，无记忆力减退典型症状，与本例不符（E错）。